能活血行气、祛风止痛的是
A. 白芷
B. 川芎
C. 两者都不是
D. 两者都是

正确答案：B。川芎

解析：本题考查的是川芎的功效。能活血行气、祛风止痛的是川芎（B对）。川芎：【功效】活血行气，祛风止痛。白芷（A错）：【功效】发散风寒，通窍止痛，燥湿止带，消肿排脓。